治疗脱疽热毒证，应首选
A. 阳和汤
B. 桃红四物汤
C. 八珍汤
D. 黄芪鳖甲汤
E. 四妙勇安汤

正确答案：E。四妙勇安汤

解析：热毒证治疗应清热解毒，化瘀止痛，方药为四妙勇安汤加减（E对）。脱疽寒湿证治法为温阳通脉，祛寒化湿，方药为阳和汤加减（A错）。血瘀证治法为活血化瘀，通络止痛，方药为桃红四物汤加减（B错）。